旋转式压片机的主要结构除上冲头、下冲头、压力盘及模圈外，还有
A. 片重调节器
B. 压力调节器
C. 加料斗
D. 出片调节器
E. 刮粒器

正确答案：A、B、C、D、E。片重调节器；压力调节器；加料斗；出片调节器；刮粒器